慢性荨麻疹属于
A. 内科心身疾病
B. 儿科心身疾病
C. 外科心身疾病
D. 口腔科心身疾病
E. 皮肤科心身疾病

正确答案：E。皮肤科心身疾病

解析：皮肤科心身疾病：神经性皮肤炎、皮肤瘙痒症、圆形脱发、多汗症、慢性荨麻疹、牛皮癣、湿疹、白化病。掌握“心身疾病”知识点。